以下关于急性化脓性腮腺炎病因的说法哪项不对
A. 主要致病菌是链球菌及肺炎双球菌
B. 常见于腹部大型外科手术后
C. 长期服用抗组织胺制剂的病员可能发生
D. 体质虚弱、长期卧床、高热或禁食的病员可能
E. 长期服用抗胆碱剂的病员可能发生

正确答案：A。主要致病菌是链球菌及肺炎双球菌

解析：本题考查急性化脓性腮腺炎的病因。急性化脓性腮腺炎的病原菌是葡萄球菌，主要是金黄色葡萄球菌，少数是链球菌，而肺炎双球菌、文森螺旋体少见（A错，为本题的正确答案）。腹部大型外科手术后（B对）和体质虚弱、长期卧床、高热或禁食的病员（D对）会造成严重的代谢紊乱，由于禁食，反射性唾液腺功能降低或停止，唾液分泌明显减少，且机体抵抗力下降，易发生逆行性感染，称之为术后腮腺炎。长期服用抗组织胺制剂（C对）和抗胆碱剂的病员（E对）唾液分泌受到抑制，口内致病菌可逆行侵入导管，发生逆行性感染。